导致血清碱性磷酸酶（ALP）升高的疾病是
A. 心肌梗死
B. 溶血性疾病
C. 胸腔积液
D. 骨骼疾病
E. 前列腺肿瘤

正确答案：D。骨骼疾病

解析：本题考查的是血清碱性磷酸酶（ALP）的临床意义。导致血清碱性磷酸酶（ALP）升高的疾病是骨髓疾病（D对）。血清碱性磷酸酶（ALP）：ALP为一组单酯酶，广泛存在于人体组织和体液中，其中以骨、肝、乳腺、小肠、肾脏的浓度较高。碱性磷酸酶可催化磷酸酯的水解反应，并有转移磷酸基的作用。当上述器官病变时，此酶的活性增强。临床意义：ALP增高见于以下情况。1.肝胆疾病；2.骨骼疾病；3.用药。溶血性疾病（B错）常见AST升高。血清天门冬氨酸氨基转移酶（AST）：AST同样是体内最重要的氨基转移酶之一，催化L-天门冬酸与α-酮戊二酸间氨基转移反应，旧称谷转氨酶（GPT）。AST同样主要存在于心肌、肝肾、骨骼肌、胰腺、脾、肺、红细胞等组织细胞中；同时也存在于正常人血浆、胆汁、脑脊液及唾液中。当富含AST的组织细胞受损时，细胞通透性增加，AST从细胞释放增加，进入血液后导致AST活力上升。临床意义：AST升高常见于以下情况。1.急性心肌梗死（AMI）；2.肝脏疾病；3.其他疾病：进行性肌肉营养不良、皮肌炎、肺栓塞、肾炎、胸膜炎、急性胰腺炎、肌肉挫伤、坏疽、溶血性疾病。4.用药。心肌梗死（A错）、前列腺肿瘤（E错）常见GGT升高。血清γ-谷氨酰转移酶（GGT）：GGT是将肽或其他化合物的γ-谷氨酰基转移至某些γ-谷氨酰受体上的酶。GGT主要存在于血清及除肌肉外的所有组织中，如在肾、胰、肝、大肠、心肌组织中，其中以肾脏最高，但血清中的GGT主要来自肝胆系统。临床意义：1.肝胆疾病；2.胰腺疾病；3.其他疾病：心肌梗死、前列腺肿瘤；4.用药。胸腹腔积液（C错）常见血清总蛋白降低。血清总蛋白、清蛋白和球蛋白：血清总蛋白、γ球蛋白、β球蛋白均由肝脏细胞合成，总蛋白为清蛋白和球蛋白之和。血浆蛋白具有维持正常的血浆胶体渗透压、机体免疫、凝血和抗凝血及营养等生理功能。当肝脏受损时，血浆蛋白减少，在炎症性肝细胞破坏和抗原性改变时，可刺激免疫系统致使γ球蛋白比例增高，此刻总蛋白量变化不大，但清蛋白和球蛋白比值（A/G）会变小，甚至发生倒置。为了反映肝脏功能的实际情况，在做血清总蛋白测定的同时，尚需要测定A/G比值。临床意义：1.血清总蛋白：（1）血清总蛋白增高：①各种原因脱水所致的血液浓缩；②血清蛋白合成增加。（2）血清总蛋白降低：①各种原因引起的血清蛋白质丢失和摄入不足；②血清水分增加可导致总蛋白浓度相对减少；③其他疾病：多种慢性消耗性疾病，如结核、肿瘤；亦见于急性大出血、严重烧伤、甲状腺功能亢进症、慢性肾脏病变、肾病综合征、胸腹腔积液、肝功能障碍、蛋白质合成障碍等。2.血清清蛋白：（1）血清清蛋白降低：①营养不良；②消耗增加；③合成障碍。（2）血清清蛋白增高：见于严重失水而致的血浆浓缩。3.球蛋白：（1）血清球蛋白增高：主要以γ-球蛋白增高为主。①炎症或慢性感染性疾病；②自身免疫性疾病；③某些恶性肿瘤。（2）血清球蛋白降低：主要是合成减少。①生理性减少；②免疫功能抑制；③低γ-球蛋白血症。4.A/G比值：（1）A/G比值减少；（2）A/G比值的动态变化。